上颌双尖牙与下颌双尖牙区别中哪一点是错误的
A. 上颌双尖牙的牙冠靠近牙体长轴
B. 下颌双尖牙的牙冠略偏牙体长轴颊侧
C. 下颌双尖牙的牙冠方圆
D. 上颌双尖牙的牙冠较窄长
E. 下颌双尖牙多为扁形单根

正确答案：B。下颌双尖牙的牙冠略偏牙体长轴颊侧

解析：本题考查上颌双尖牙与下颌双尖牙的区别。下颌双尖牙的牙冠略偏牙体长轴颊侧（B错，为本题正确答案）不符合上颌与下颌双尖牙的区别。下颌双尖牙的牙冠明显向舌侧倾斜，颊尖接近牙体长轴或位于牙体长轴上；上颌双尖牙的牙冠较直，颊舌尖位于牙体长轴两侧（A对）。下颌双尖牙的颊舌径与近远中径相近，牙冠方圆（C对），上颌双尖牙的颊舌径大于近远中径，牙冠扁且窄长（D对）。下颌双尖牙均为扁形单根（E对），根尖略偏远中。